脑血栓形成痰湿壅闭心神证的中医治法是
A. 清热化痰，醒神开窍
B. 辛温开窍，豁痰息风
C. 益气回阳，救阴固脱
D. 平肝潜阳，活血通络
E. 益气养血，化瘀通络

正确答案：B。辛温开窍，豁痰息风

解析：脑血栓形成痰湿壅闭心神证的病机为痰湿偏盛，风携痰湿，上蒙清窍，内闭经络，故以突然昏仆，不省人事，牙关紧闭，口噤不开为主症，治法当为辛温开窍，豁痰息风（B对），急用辛温开窍醒神的苏合香丸灌服用涤痰熄风的涤痰汤加减。清热化痰，醒神开窍（A错），适用于痰热内闭清窍证。益气回阳，救阴固脱（C错），适用于元气败脱，心神涣散证。平肝潜阳，活血通络（D错），适用于肝阳暴亢，风火上扰证。益气养血，化瘀通络（E错）适用于气虚血瘀证。